盐酸多柔比星毒性作用主要是骨髓抑制和心脏毒性，产生这一毒副作用的原因可能是
A. 在体内发生脱甲基化反应，生成的羟基代谢物具有较大毒性
B. 在体内容易进一步氧化，生产的醛基代谢物具有较大的毒性
C. 在体内发生醌环易被还原成半醌自由基，诱发脂质过氧反应
D. 在体内发生氨基糖开环反应，诱发脂质过氧反应
E. 在体内发生脱水反应，代谢具有较大毒性

正确答案：C。在体内发生醌环易被还原成半醌自由基，诱发脂质过氧反应

解析：本题考查多柔比星。盐酸多柔比星为蒽醌类抗肿瘤抗生素，这类药物的毒性主要为骨髓抑制和心脏毒性。可能是醌环被还原成半醌自由基，诱发了脂质过氧化反应（C对），引起心肌损伤。